分析性研究用
A. 历史性对照研究
B. 非随机同期对照试验
C. 随机对照试验
D. 序贯序贯临床试验
E. 病历对照研究

正确答案：E。病历对照研究

解析：本题考查分析性流行病学。分析性流行病学主要包括病例对照研究（E对）和群组研究。 历史性对照研究（A错）、非随机同期对照试验（B错）、 随机对照试验（C错）和序贯序贯临床试验（D错）属于临床试验，是实验流行病学的内容。